邻面龋患龋率最高的年龄为
A. 青少年
B. 儿童
C. 成年人
D. 老人
E. 以上均好发

正确答案：D。老人

解析：本题考查邻面龋患龋率最高的年龄。邻面龋是指发生于牙近远中面的龋损。老人由于牙齿缺失或者牙龈退缩等原因导致牙齿邻面暴露或者出现间隙，成为牙菌斑聚集的场所，故而邻面龋患龋率最高的年龄为老人（D对）。青少年（A错）、儿童（B错）、成年人（C错）牙与牙之间一般有较好的邻接关系，无间隙，牙菌斑不易聚集，因而不易发生龋。